手术治疗需患者家属签字为据的
A. 最优化原则
B. 患者至上原则
C. 知情同意原则
D. 保密守信原则
E. 酌情隐瞒原则

正确答案：C。知情同意原则

解析：本题考查临床诊疗和临床诊断的伦理。知情同意原则（C对）是指医务人员在选择和确定疾病的诊疗方案时要取得患者知情和自由选择与决定，对于一些特殊检查、特殊治疗和手术以患者或患者家属（无家属者由监护人）签字为据。